女，60岁，患丙肝多年，今日出现昏迷症状，请问应该使用何种药物治疗
A. 支链氨基酸
B. 羟基化合物
C. 芳香氨基酸
D. 抗生素
E. 碱性肥皂水灌肠

正确答案：A。支链氨基酸

解析：患者女，60岁，患丙肝多年，有昏迷症状，结合患者的病史和表现，考虑为肝性脑病，故应给予支链氨基酸治疗，它可竞争性抑制芳香族氨基酸进入大脑，使假性神经递质的形成减少(A对BC错)。口服抗生素可抑制肠道产尿素酶的细菌，减少氨的生成，有利于肝性脑病的治疗和预防，常用的抗生素有利福昔明、甲硝唑、新霉素等（D错）。碱性肥皂水灌肠会加重肝性脑病（E错）。